人工诱导的对DNP-BSA耐受的家兔，若想使该家兔产生DNP抗体，需注射的物质是
A. DNP-HAS
B. DNP-BSA
C. BSA
D. HAS
E. OA

正确答案：A。DNP-HAS

解析：注射置换载体的新抗原将耐受原的半抗原部分连接到另一载体上，形成新抗原。例如，事先以BSA-DNP诱发家兔产生耐受性，将DNP连接至HAS上，即DNP-HAS（A对），若将其注射至耐受家兔，可使其再度出现抗DNP抗体，即原有的特异性免疫耐受性终止。